除另有规定外，应置凉暗处贮存的制剂是
A. 栓剂
B. 气雾剂
C. 乳膏剂
D. 软膏剂
E. 喷雾剂

正确答案：B。气雾剂

解析：本题考查的是气雾剂的储存。除另有规定外，应置凉暗处贮存的制剂是气雾剂（B对）。气雾剂应置凉暗处贮存，并避免暴晒、受热、敲打、撞击。除另有规定外，栓剂（A错）应在30℃以下密闭贮存和运输，防止因受热、受潮而变形、发霉、变质。除另有规定外，软膏剂（D错）应避光密封贮存。乳膏剂（C错）应避光密封置25℃以下贮存，不得冷冻。喷雾剂（E错）应避光密封贮存。